脂肪酸氧化分解的主要方式是
A. β-还原方式
B. 脂肪动员
C. β-氧化方式
D. α-氧化方式
E. α-还原方式

正确答案：C。β-氧化方式

解析：脂肪酸的β-氧化方式是脂肪酸氧化分解的主要方式。掌握“脂肪的分解代谢”知识点。